《中国居民平衡膳食宝塔》中，所占比重最少的食物是
A. 谷类食物
B. 蔬菜和水果
C. 肉类等动物性食物
D. 奶类和豆类
E. 油脂类

正确答案：E。油脂类